女性，28岁，已婚，妊娠14周。因消瘦、乏力、多食、心悸3个月就诊。查体：皮温升高，手震颤，实验室检查TSH降低。病人于抗甲亢药物减药期发生妊娠，希望保胎，哪种治疗措施是正确的
A. 立即行甲状腺手术
B. 继续药物治疗，待妊娠中期行甲状腺手术
C. 同位素治疗
D. 继续药物治疗至分娩
E. 以上都不对

正确答案：A。立即行甲状腺手术

解析：青年患者，妊娠14周，消瘦、乏力、多食、心悸3个月就诊（典型的高代谢症状），查体：皮温升高，手震颤（典型高代谢体征），实验室检查：TSH降低（提示甲亢），于抗甲亢药物减药期发生妊娠，根据患者的病史、临床症状、体征及实验室检查，考虑诊断为甲状腺功能亢进，患者属于妊娠早中期之间，且使用抗甲状腺药物治疗后再复发，应采取的措施是立即甲状腺手术（A对）。该患者符合外科学手术治疗条件，不宜在继续药物治疗（BD错）。妊娠和哺乳期禁止同位素治疗（C错）。